柴胡的原植物是
A. 狭叶柴胡
B. 银州柴胡
C. 柴胡
D. 兴安柴胡
E. 竹叶柴胡

正确答案：A、C。狭叶柴胡；柴胡

解析：本题考查的是柴胡的来源。柴胡的原植物是对狭叶柴胡（A对）或柴胡（C对）。柴胡：【来源】为伞形科植物柴胡或狭叶柴胡的干燥根，分别习称“北柴胡”及“南柴胡”。来源为银州柴胡（B错）、兴安柴胡（D错）与竹叶柴胡（E错）的药材，2022年考试指南未明确说明。